有丰富的感受器对温度和触压敏感，可防止不适宜的食物进入口腔，并保持食物在上下牙列间，以便对其切割
A. 舌在咀嚼中的作用
B. 唇在咀嚼中的作用
C. 颊在咀嚼中的作用
D. 腭在咀嚼中的作用
E. 咽在咀嚼中的作用

正确答案：B。唇在咀嚼中的作用

解析：唇在咀嚼中的作用：唇有丰富的感受器对温度和触压敏感，可防止不适宜的食物进入口腔。唇推送并保持食物在上下牙列间，以便对其切割；唇帮助转运食物。上下唇闭合可防止食物或饮料从口腔溢出。掌握“牙动度和唇、舌、腭对咀嚼的作用”知识点。